艾滋病传播方式不包括
A. 蚊虫叮咬
B. 同性性行为
C. 血液和血制品
D. 医源性传播
E. 胎内感染

正确答案：A。蚊虫叮咬

解析：本题考查艾滋病的传播途径。艾滋病传播主要有三种途径，包括：异性及同性的性接触传播（B对）、医源性传播（D对）和血液感染（C对）、母婴垂直传播（E对）三种途径传播。蚊虫叮咬（A错，为本题正确答案）无法传播艾滋病。